急性脊髓炎的可能诱因是
A. 疫苗接种
B. 肠道感染
C. 败血症
D. 肺炎
E. 强直性脊柱炎

正确答案：A。疫苗接种

解析：急性脊髓炎是指各种感染后引起自身免疫反应所致的急性横贯性脊髓炎性病变。病因不明，包括了各种呼吸道、消化道等的感染以及疫苗接种之后间接性的引起脊髓的自身免疫。因而感染以及疫苗接种（A对）是急性脊髓炎的诱因。外伤、劳累、受凉等这些容易导致机体免疫功能低下的因素是发病的诱因。肠道感染、败血症、肺炎均为感染性疾病，是急性脊髓炎的诱因。